舌下片的崩解时限是
A. 2分钟
B. 5分钟
C. 10分钟
D. 15分钟
E. 30分钟

正确答案：B。5分钟

解析：本题考查片剂的崩解时限。舌下片的崩解时限是5分钟（B对）；薄膜衣片、含片的崩解时间为30min（E错）；分散片、可溶片的崩解时限为3min；舌下片、泡腾片的崩解时限为5min；普通片剂为15min（D错）。